根据对人体的致病性，能引起人类食物中毒的细菌属于
A. 条件致病菌
B. 酵母菌
C. 非致病菌
D. 致病菌
E. 腐败菌

正确答案：D。致病菌